原发性肺结核和继发性肺结核均可见的病理类型是
A. 慢性纤维空洞型肺结核
B. 浸润性肺结核
C. 结核球
D. 局灶性肺结核
E. 粟粒性肺结核

正确答案：E。粟粒性肺结核

解析：原发性和继发性肺结核可通过血道播散引起粟粒性结核（E对）。慢性纤维空洞型肺结核（A错）、浸润性肺结核（B错）、结核球（C错）、局灶性肺结核（D错）、干酪性肺炎、结核性胸膜炎均为继发性肺结核的病理类型。